既可用于男性性功能减退又可用于女性绝经后晚期乳腺癌治疗的药物是
A. 十一酸睾酮
B. 西地那非
C. 特拉唑嗪
D. 坦洛新
E. 非那雄胺

正确答案：A。十一酸睾酮

解析：本题考查十一酸睾酮。既可用于男性性功能减退又可用于女性绝经后晚期乳腺癌治疗的药物是十一酸睾酮（A对）。西地那非（B错）为5型磷酸二脂酶抑制剂，用于治疗勃起功能障碍。特拉唑嗪（C错）用于良性前列腺增生症和高血压的治疗。坦洛新（D错）用于因前列腺增生所致的排尿障碍等症状。非那雄胺（E错）用于治疗已有症状的良性前列腺增生症。